原发性肝癌最理想的肿瘤标记物
A. AFP
B. GGT
C. CA199
D. CA125
E. CEA

正确答案：A。AFP

解析：AFP（甲胎蛋白）是在胎儿早期由肝脏和卵黄囊合成的一种血清糖蛋白，出生后，AFP的合成很快受到抑制。当肝细胞或生殖腺胚胎组织发生恶性病变时，有关基因重新被激活，使原来丧失合成AFP的细胞又重新开始合成，以致血中AFP含量明显升高。因此原发性肝细胞性肝癌最理想的肿瘤标记物是AFP（A对）。GGT2（九版诊断学P364）（B错）为γ-谷氨酰转移酶的中分子量形式，一种成分主要用于和AFP联合检测诊断肝癌，另一种成分主要用于胆道阻塞性疾病的诊断。CA199（九版诊断学P419）（C错）即糖链抗原199，在胰腺癌、肝胆和胃肠道疾病时可明显升高，目前临床上主要作为胰腺癌的首选肿瘤标志物。CA125（九版诊断学P420）（D错）即癌抗原125，对诊断卵巢癌有较大临床价值，尤其对观察治疗效果和判断复发较为灵敏。CEA（九版诊断学P417）（E错）即癌胚抗原，是一种广谱性肿瘤标志物，可在多种肿瘤中表达，脏器特异性低，在临床上主要用于结直肠癌的复发监测。